消化性溃疡引起的疼痛，以何者最具特征性
A. 中上腹疼痛
B. 饥饿性疼痛
C. 反复发作性疼痛
D. 节律性疼痛
E. 长期疼痛

正确答案：D。节律性疼痛

解析：本题考查消化性溃疡。慢性病程、周期性发作的节律性上腹疼痛（D对）是诊断消化性溃疡的重要线索，但是确诊有赖于胃镜检查。